下述某一项原因可导致深龋洞作银汞充填，在磨光时患者出现闪电式牙痛
A. 磨光时加压过大
B. 磨光时间过早
C. 磨光时间过迟
D. 银汞合金含汞过多
E. 局部电流刺激

正确答案：E。局部电流刺激

解析：本题考查在磨光时患者出现闪电式牙痛的原因。深龋洞作银汞充填，磨光牙面时，会摩擦产热，而银汞合金由银、锡、铜、锌异种金属组成，继而生成局部电流刺激，银汞合金具有导电性，如果充填时未垫底，电流刺激会通过银汞合金传入牙髓，引起闪电式牙痛（E对）。磨光时加压过大，产热多，生成的电流多，闪电式牙痛会更明显，但不是出现闪电式牙痛的本质原因（A错）。磨光时间过早，银汞合金尚未固化完全，会使银汞合金充填体破裂（B错）。磨光时间过迟，银汞合金完全固化，强度增加，磨光困难会增加产热，是出现闪电式牙痛的促进因素，不是本质原因（C错）。银汞合金含汞过多会降低银汞合金的强度，磨光时破坏修复体，一般不会出现闪电式样牙痛（D错）。